致肾损害和肾衰竭的不良事件是
A. 2008刺五加
B. 2001马兜铃酸
C. 2006鱼腥草素钠
D. 2004罗非昔布
E. 2006克林霉素磷酸酯

正确答案：B。2001马兜铃酸

解析：本题考查药源性疾病。致肾损害和肾衰竭的不良事件是2001马兜铃酸（B对）。刺五加（A错）不良反应有失眠，过敏，忧郁和焦虑。鱼腥草素钠（C错）的不良反应有头痛、心悸、恶心、困倦、胃部不适、慢性支气管炎及其它上呼吸道感染性疾病等。罗非昔布（D错）可能会引起贫血、水肿、高血压、眩晕、恶心、胃灼热、腹泻或导致肝功能不全等症状。克林霉素磷酸酯（E错）常见恶心、呕吐、腹痛、腹泻等。